少尿型急性肾衰竭的少尿期不会出现
A. 高血钾症
B. 酸中毒
C. 水中毒
D. 尿相对密度降低
E. 尿钠降低

正确答案：E。尿钠降低

解析：少尿期不仅尿量显著减少，而且还伴有严重的内环境紊乱，常有以下主要的功能代谢变化：(1)尿的变化：①少尿或无尿②低比重尿（D对③尿钠高（E错，为本题正确答案）④血尿、蛋白尿、管型尿(2)水中毒（C对）(3)高钾血症（A对）(4)代谢性酸中毒（B对）(5) 氮质血症等。